氨基酮类镇痛药物是
A. 吗啡
B. 盐酸哌替啶
C. 盐酸曲马多
D. 盐酸美沙酮
E. 酒石酸布托啡诺

正确答案：D。盐酸美沙酮

解析：本题考查镇痛药物的结构特点。氨基酮类药物可以看作是仅仅保留吗啡结构中A环的类似物，也可以被称为二苯基庚酮类或苯基丙胺类，为高度柔性的开链吗啡类似物。其代表药物是美沙酮（D对）。